与青霉素合用，可降低青霉素的排泄速度，从而增强青霉素抗菌活性的药物是
A. 丙磺舒
B. 克拉维酸
C. 舒巴坦钠
D. 他唑巴坦
E. 甲氧苄啶

正确答案：A。丙磺舒

解析：本题考查药物的相互作用。丙磺舒（A对）与青霉素合用，发生竞争性抑制，可降低青霉素的排泄速度，增强青霉素抗菌活性。克拉维酸（B错）可与阿莫西林组成复方制剂；舒巴坦钠（C错）可与氨苄西林相连提高抗菌效果；他唑巴坦（D错）为处方类抗菌素；甲氧苄啶（E错）为广谱抗生素,单用可治疗单纯性尿路感染，和磺胺类药物合用起到消炎作用。